二尖瓣狭窄时，体循环栓塞最常发生于
A. 脾动脉
B. 脑动脉
C. 肾动脉
D. 下肢动脉
E. 肠系膜动脉

正确答案：B。脑动脉

解析：20%二尖瓣狭窄患者可发生体循环栓塞，其最常发生于脑动脉（B对），约占2/3。体循环栓塞也可出现于脾动脉（A错）、肾动脉（C错）、下肢动脉（D错）、肠系膜动脉（E错），但都不如脑动脉栓塞常见。